表面灰黄色至黑褐色，断面皮部散有棕黄色小油点，形成层环棕色，气芳香的中药材是
A. 葛根
B. 柴胡
C. 赤芍
D. 南沙参
E. 北沙参

正确答案：B。柴胡